女，31岁。间断腹痛、腹泻10个月。大便3-4次／天，无发热。粪镜检：红细胞及白细胞满视野。应用甲硝唑、左氧氟沙星治疗2周症状无缓解。最可能的诊断是
A. 阿米巴肠病
B. 肠易激综合征
C. 慢性细菌性痢疾
D. 结肠癌
E. 溃疡性结肠炎

正确答案：E。溃疡性结肠炎

解析：中年女性，间断腹痛、腹泻10个月，大便3-4次／天（腹痛、腹泻是溃疡性结肠炎常见表现），无发热。粪镜检：红细胞及白细胞满视野（便血），最可能的诊断为溃疡性结肠炎（E对）。阿米巴肠病（P375）（A错）粪便或结肠镜取溃疡渗出物检查可找到溶组织阿米巴滋养体或包囊。肠易激综合征（B错）粪便无脓血，粪镜检正常。慢性细菌性痢疾（C错），粪便致病菌培养可分离出致病菌，抗生素可治愈。结肠癌（P382）（D错），起病隐匿，早期常仅见粪便隐血阳性或伴有血便，无腹痛症状。